ST段一过性抬高的心电图表现，应诊断为
A. 房颤
B. 变异型心绞痛
C. 室性早搏
D. 心绞痛
E. 室性心动过速

正确答案：B。变异型心绞痛

解析：变异性心绞痛患者几乎完全都在静息情况下发生，无体力劳动或情绪激动等诱因，心电图特点为一过性ST段抬高并常伴有高耸T波和对应导联的ST段下移（B对）。心房颤动的心电图特点为正常P波消食，代以大小不等、形状各异的颤动波（f波），通常以V1导联最明显，RR绝对不齐，QRS波一般不增宽（A错）。室性早搏的心电图特征为期前出现的QRS-T波前无P波或无相关的P波；提前发生的QRS波，宽大畸形，时限通常＞0.12S（C错）。心绞痛发作时绝大多数患者可出现暂时性心肌缺血引起的ST段移位。因心内膜下心肌更容易缺血，故常见反映心内膜下心肌缺血的ST段压低（大于等于0.1mV），发作缓解后恢复；有时出现T波倒置（D错）。室性心动过速属于宽QRS波心动过速类型，心电图表现为心频率多在140-200次／分，节律可稍不齐；QRS波群形态宽大畸形，时限通常＞第0.12秒；如能发现P波，并且P波频率慢于QRS波频率，PR无固定关系（E错）。